流行病学实验研究采用盲法的目的是为了
A. 受试对象的安全
B. 减少主观偏倚
C. 增加统计检验效力
D. 减少样本量
E. 防止失访

正确答案：B。减少主观偏倚